某女，45岁。心悸易惊，心烦失眠，五心烦热，口干，盗汗，思虑劳心则症状加重，伴耳鸣腰酸，头晕目眩，急躁易怒；舌红少津，脉细数。应采用的治法是
A. 补血养心，益气安神
B. 温补心阳，安神定悸
C. 滋阴清火，养心安神
D. 活血化瘀，理气通络
E. 化气行水，宁心安神

正确答案：C。滋阴清火，养心安神

解析：本题考查的是心悸的辨证论治。某女，45岁。心悸易惊，心烦失眠，五心烦热，口干，盗汗，思虑劳心则症状加重，伴耳鸣腰酸，头晕目眩，急躁易怒；舌红少津，脉细数。应采用的治法是滋阴清火，养心安神（C对）。心悸是患者自觉心中悸动，惊惕不安，甚则不能自主的疾病，临床一般多呈反复发作性，每因情志波动或劳累而发作，且常伴胸闷、气短、失眠、健忘、眩晕、耳鸣等症状。西医学中心律失常以及各种心脏病等出现上述症状时，可参考此内容辨证论治。（一）心脾两虚证：【症状】心悸气短，头晕目眩，失眠健忘，面色无华，倦怠乏力，纳呆食少。舌淡红，脉细弱。【治法】补血养心，益气安神（A错）。（二）阴虚火旺证：【症状】心悸易惊，心烦失眠，五心烦热，口干，盗汗，思虑劳心则症状加重，伴耳鸣腰酸，头晕目眩，急躁易怒。舌红少津，苔少或无，脉细数。【治法】滋阴清火，养心安神。（三）心阳不振证：【症状】心悸不安，胸闷气短，动则尤甚，面色苍白，形寒肢冷，舌淡苔白。脉虚弱或沉细无力。【治法】温补心阳，安神定悸（B错）。（四）瘀阻心脉证：【症状】心悸不安，胸闷不舒，心痛时作，痛如针刺，唇甲青紫。舌质紫暗或有瘀斑，脉涩或结或代。【治法】活血化瘀，理气通络（D错）。